用于治疗支原体肺炎的药物是
A. 氯霉素
B. 青霉素
C. 羧苄青霉素
D. 四环素
E. 利福平

正确答案：D。四环素

解析：本题考查四环素。用于治疗支原体肺炎的药物是四环素（D对）。氯霉素（A错）是敏感菌株所致伤寒、副伤寒的首选药物。青霉素（B错）适用于溶血性链球菌、肺炎链球菌、对青霉素敏感（不产青霉素酶）金葡菌等革兰阳性球菌所致的感染以及破伤风、气性坏疽、流行性脑脊髓膜炎、鼠咬热、梅毒、淋病。羧苄青霉素（C错）主要用于绿脓杆菌及部分变形杆菌、大肠杆菌所引起的中耳炎、肺炎、心内膜炎、膀胱炎、肾盂肾炎、手术后的脑膜炎、败血症、胆道感染、皮肤及软组织感染。利福平（E错）对结核分枝杆菌和部分非结核分枝杆菌（包括麻风分枝杆菌等）在宿主细胞内外均有明显的杀菌作用。